龋损下方牙髓血管充血，血管通透性增加，液体渗出，组织水肿，有纤维蛋白渗出，此时称为
A. 急性牙周脓肿
B. 急性增生性牙髓炎
C. 急性化脓性牙髓炎
D. 急性浆液性根尖周炎
E. 急性浆液性牙髓炎

正确答案：E。急性浆液性牙髓炎

解析：急性牙髓炎早期病变局限在受刺激部位相对应的牙髓，如龋损下方，牙髓血管扩张充血，血管通透性增加，液体渗出，组织水肿，沿血管壁周围有纤维蛋白渗出，这时称急性浆液性牙髓炎。掌握“急、慢性牙髓炎”知识点。